右心衰竭时产生水肿的始动因素是
A. 毛细血管滤过压增高
B. 毛细血管通透性增加
C. 肾小球滤过率下降
D. 血浆胶体渗透压降低
E. 淋巴液回流障碍

正确答案：A。毛细血管滤过压增高

解析：毛细血管有效滤过压=（毛细血管血压＋组织液胶体渗透压）－（组织液静水压＋血浆胶体渗透压）（九版生理学P126）。右心衰竭时，血液淤积于右心室，使右心室舒张末期压力升高，静脉回流受阻，是全身毛细血管后阻力增大，导致毛细血管毛细血管滤过压增加（A对），引起全身水肿。毛细血管通透性增加（B错）常见于感染、烧伤、过敏等情况。肾小球滤过率下降（C错）常见于肾炎性水肿（P465）。血浆胶体渗透压降低（D错）常见于营养不良或某些肝肾疾病。淋巴回流障碍（E错）常见于丝虫病患者的淋巴管被堵塞时。